村卫生室和社区卫生服务站（）至少举办1次健康知识讲座
A. 每月
B. 每2个月
C. 每季度
D. 每6个月
E. 每年

正确答案：B。每2个月